男，54岁。呕血、黑便2天，嗜睡、行为改变1天。实验室检查：ALT35U/L，AST72U/L，Alb27.3g/L。腹部B超示脾大。最可能的诊断是
A. 胃癌
B. 肝硬化失代偿期
C. 急性胃黏膜病变
D. 消化性溃疡
E. 食管贲门黏膜撕裂综合征

正确答案：B。肝硬化失代偿期

解析：中年男性患者，呕血、黑便2天（上消化道出血的表现），嗜睡、行为改变1天（肝性脑病2期的表现），实验室检查：AST72U/L（天门冬氨酸氨基转移酶正常值为8～40U/L，提示肝细胞受损），Alb27.3g/L（白蛋白正常值为40～55g/L，提示白蛋白减少，肝功能减退），腹部B超示脾大，综合患者的病史、实验室检查和影像学检查，可初步诊断为肝硬化失代偿期（B对）并发肝性脑病。胃癌（A错）、急性胃黏膜病变（C错）、消化性溃疡（D错）、食管贲门黏膜撕裂综合征（E错）一般不会有脾大、嗜睡、行为改变等表现。